为评估急性淋巴细胞白血病患者用药的预后情况，哪项不能作为观察结局
A. 缓解
B. 复发
C. 车祸死亡
D. 失访
E. 自行出组

正确答案：B。复发

解析：评估急性淋巴细胞白血病患者用药的预后情况，缓解（A对）、车祸死亡（C对）、失访（D对）、自行出组（E对）可作为观察结局，复发不能作为观察结局（B错，为本题的正确答案）。